男，30岁，反复咯血6年，多为痰中带血，偶有一次大咯血100ml，无发热，胸部X线片多次检查未见异常。为明确诊断应选择以下哪项检查
A. 支气管造影
B. 支气管镜
C. 胸部高分辨CT
D. CT肺动脉造影
E. 结核菌素检查

正确答案：C。胸部高分辨CT

解析：该患者男，30岁，表现为反复咯血，多为痰中带血（表现为干性支气管扩张症表现），偶有大咯血，无发热，胸部X线片多次检查未见异常，结合患者的表现，为明确诊断，应行胸部高分辨CT检查（支气管扩张症的确诊方法）（C对）。支气管碘油造影：可确诊支气管扩张，但因其为创伤性检查，现已被高分辨CT(HRCT)取代（A错）。纤维支气管镜检查：当支气管扩张呈局灶性且位于段支气管以上时，可发现弹坑样改变，可通过纤维支气管镜采样用于病原学诊断及病理诊断。纤支镜检查还可明确出血、扩张或阻塞的部位，还可经纤支镜进行局部灌洗，采取灌洗液标本进行涂片、细菌学和细胞学检查，协助诊断和指导治疗（B错）。CT肺动脉造影(CTPA) PTE一线确诊手段，能够准确发现段以上肺动脉内的血栓（D错）。结核菌素试验广泛应用于检出结核分枝杆菌的感染，而非检出结核病。结核菌素试验对儿童、少年和青年的结核病诊断有参考意义（E错）。